可以判断结晶纯度的方法有
A. 均一的晶形
B. 均匀的色泽
C. 熔点
D. 色谱行为
E. 熔距

正确答案：A、B、C、D、E。均一的晶形；均匀的色泽；熔点；色谱行为；熔距